气的升降出入运行失常所致的病理变化有
A. 气虚
B. 气逆
C. 气陷
D. 气闭
E. 气脱

正确答案：B、C、D、E。气逆；气陷；气闭；气脱

解析：本题考查的是气机失调。气的升降出入运行失常所致的病理变化有气逆（B对）、气陷（C对）、气闭（D对）与气脱（E对）。气失调，主要包括气虚和气机失调两方面的病机变化。（1）气虚（A错）：气虚，是指元气耗损，功能失调，脏腑功能衰退，抗病能力下降的病机变化。主要由于先天禀赋不足，或后天失养，或肺脾肾的功能失调而致气的生成不足；也可因劳倦内伤，久病不复等而致。（2）气机失调：气机失调，是指气的升降出入运行失常，而引起的气滞、气逆、气陷、气闭和气脱等病机变化。气运行于经络之中，卫气运行于脉外，贵乎流通畅达。若因外感、内伤，或痰食中阻，即可阻碍气之运行，导致气的运行失常。气行失常，可涉及五脏六腑、表里内外、四肢九窍等各方面的多种病变。